维系DNA双链间碱基配对的化学键是
A. 肽键
B. 氢键
C. 糖苷键
D. 疏水键
E. 磷酸二酯键

正确答案：B。氢键